下列哪项不是真心痛的主要病因
A. 心气心阳亏虚
B. 心阴心血不足
C. 外邪入侵
D. 寒凝痰阻
E. 心脉瘀痹

正确答案：C。外邪入侵

解析：心绞痛的中医病因病机有心血瘀阻、痰浊内阻、阴寒凝滞、气虚血瘀、气阴两虚、心肾阳虚，主要病机为心脉痹阻（E对），心脉不畅发为本病。寒凝痰阻（D对），胸阳失展，气机痹阻，脉络阻滞发为本病。心气心阳亏虚（A对），胸阳不振，气机痹阻胸阳不振，发为本病。心阴心血不足（B对），血行瘀滞，阻滞心脉，发为本病。外邪侵袭（C错，为本题正确答案）可诱发心脉不畅而发病，但不是真心痛的主要病因。